患者女，22岁，右下6龋损，已完成治疗，准备做金属烤瓷冠，患者的牙弓弧度和邻牙凸度均正常，在恢复轴面凸度时，正确的是
A. 舌侧颈1/3
B. 颊侧颈1/3
C. 近中近（牙合）1/3偏舌
D. 远中近（牙合）1/3偏舌
E. 舌侧（牙合）1/3

正确答案：B。颊侧颈1/3

解析：牙体缺损的单个全冠修复在修复基本原则（5、6之间多位于颊1/3与中1/3交界，6、7之间多位于邻面中1/3处）之内，尽量恢复正常生理状态下的轴面突度和邻接关系。而下颌6的外形高点在颊侧为颈部1/3处，舌侧位于舌侧中1/3处，近远中接触区均靠近（牙合）1/3偏颊侧。掌握“烤瓷熔附金属冠”知识点。